右侧结肠癌最多见的大体形态是
A. 浸润型
B. 息肉状
C. 肿块型
D. 浸润溃疡型
E. 弥漫型

正确答案：C。肿块型